术后3～6日发热的最常见的原因是
A. 代谢异常
B. 低血压
C. 肺不张
D. 输血反应
E. 感染

正确答案：E。感染

解析：术后发热的原因分为感染性发热与非感染性发热。非感染性发热如输血反应、过敏反应、广泛组织损伤等原因引起的发热，一般出现较早，平均在术后1.4日。感染性发热更多见，但出现较晚，平均在术后2.7日。故术后3～6日发热的常见原因是感染（E对）。代谢异常（A错）导致的发热多由颅脑外伤损伤体温调节中枢或甲亢产热过多引起，术后一般不出现代谢异常型发热；低血压（B错）导致全身灌注不足，机体缺氧，而非发热；肺不张（C错）易导致肺部感染而出现发热，属于感染型发热；输血反应（D错）属非感染性发热，出现发热的时间一般多发生于输血开始后的15分钟到2小时以内。